利用水分子迅速转动产生剧烈碰撞与摩擦而转化的热量进行干燥的设备称为
A. 红外干燥器
B. 喷雾干燥机
C. 流化床干燥机
D. 微波干燥器
E. 箱式干燥器

正确答案：D。微波干燥器